测定化合物纯度的常用方法是
A. 紫外光谱
B. 红外光谱
C. 薄层色谱
D. 柱色谱
E. 超声波

正确答案：C。薄层色谱

解析：本题考查的是色谱法。测定化合物纯度的常用方法是薄层色谱（C对）。色谱法：是鉴定结晶纯度的一种常用方法。常用的色谱法有纸色谱、纸上电泳和薄层色谱。红外分光光度法是鉴别化合物和确定物质结构的常用手段之一。在药物分析中，以红外光谱（B错）具有的“指纹”特性作为药物鉴定的依据，是各国药典共同采用的方法，但通常仅限于西药等单组分、单纯化合物的鉴定。柱色谱法（D错），柱色谱可分为分配柱色谱和吸附柱色谱两种原理。将两相溶剂中的一相涂覆在硅胶等多孔载体上，作为固定相，填充在色谱管中，然后加入与固定相不相混溶的另一相溶剂（流动相）冲洗色谱柱。超声提取法（E错）是采用超声波辅助溶剂进行提取的方法。超声波是一种弹性机械振动波，它是指传播的振动频率在弹性介质中高达20kHz的一种机械波。